微寒，祛风湿，利湿退黄的是
A. 秦艽
B. 木瓜
C. 伸筋草
D. 络石藤
E. 千年健

正确答案：A。秦艽

解析：本题考查的是秦艽的性味归经与功效。微寒，功能祛风湿，利湿退黄的是秦艽（A对）。秦艽：【性味归经】苦、辛，微寒。归胃、肝、胆、大肠经。【功效】祛风湿，舒筋络，清虚热，利湿退黄。木瓜（B错）：【性味归经】酸，温。归肝、脾经。【功效】舒筋活络，化湿和中，生津开胃。伸筋草（C错）：【性味归经】苦、辛，温。归肝经。【功效】祛风除湿，舒筋通络，活血消肿。络石藤（D错）：【性味归经】苦，微寒。归心、肝经。【功效】祛风通络，凉血消肿。千年健（E错）：【性味归经】苦、辛，温。归肝、肾经。【功效】祛风湿，强筋骨。